下列吡喃糖苷中最容易被水解的是
A. 七碳糖苷
B. 五碳糖苷
C. 甲基五碳糖苷
D. 六碳糖苷
E. 糖上连接羧基的糖苷

正确答案：B。五碳糖苷